具有行气止痛，杀虫疗癣作用的药物是
A. 乌药
B. 沉香
C. 川楝子
D. 青木香
E. 薤白

正确答案：C。川楝子

解析：川楝子的功效为疏肝泄热，行气止痛，杀虫疗癣（C对）。川楝子苦寒清泄，既能清肝火，又能行气止痛，为治肝郁气滞疼痛之良药；也可治蛔虫等引起的虫积腹痛；外用杀虫而疗癣。乌药的功效为行气止痛，温肾散寒（A错）。沉香的功效为行气止痛，温肾散寒（B错）。青木香的功效为行气止痛，解毒消肿（D错）。薤白的功效为通阳散结，行气异滞（E错）。